初产妇，孕37周，清晨骤醒发现躺在血中，急诊入院，查血压12/8kPa（90/60mmHg），脉搏120次/分，神清，胎心音160次/分，阴道少量活动性流血你认为最恰当的处理是
A. 止血，输液，等待足月终止妊娠
B. 争取破膜后头皮钳牵引压迫止血
C. 输血补液，待血压心率稳定，胎心正常后行剖宫产术
D. 立即备血，急诊剖宫产术
E. 备血或输血情况下根据胎方位及胎产式决定分娩方式

正确答案：D。立即备血，急诊剖宫产术

解析：本例是妊娠晚期无痛性阴道流血，诊断为前置胎盘。此孕妇出血多，出现了休克症状，故应立即行剖宫产术。掌握“前置胎盘”知识点。